血清总胆红素、结合胆红素、非结合胆红素均中度增加，可见于
A. 蚕豆病
B. 胆石症
C. 珠蛋白生成障碍性贫血
D. 急性黄疸性肝炎
E. 胰头癌

正确答案：D。急性黄疸性肝炎

解析：血清总胆红素、结合胆红素、非结合胆红素均中度增加，可见于急性黄疸性肝炎（D对），急性黄疸性肝炎为肝细胞性黄疸，肝细胞性黄疸时，结合与非结合胆红素均中度增高，故总胆红素也相应增高。蚕豆病（A错）、珠蛋白生成障碍性贫血（C错）表现为溶血性贫血，故总胆红素及非结合胆红素增高，而结合胆红素降低。胆石症（B错）、胰头癌（E错）为胆汁淤积性黄疸，故总胆红素及结合性胆红素增高，非结合胆红素降低。